在研究冠心病危险因素病例对照研究中，所选择的对照不能包括
A. 胆结石患者
B. 高血压患者
C. 消化性溃疡患者
D. 白内障患者
E. 肺气肿患者

正确答案：B。高血压患者